急性风湿性关节炎多属于中医学中的
A. 风湿热痹
B. 着痹
C. 行痹
D. 痛痹
E. 痹

正确答案：C。行痹

解析：行痹的临床表现肢体酸痛，痛而游走无定处。病因风寒湿三邪中以风邪偏胜，而风邪易于游走所致（C对）。关节肿胀，肌肤掀红，灼热疼痛，为热邪盛，称风湿热痹（A错）。关节酸痛、重着、漫肿，为湿邪盛，称为着痹（B错）。关节痛势剧烈，痛有定处，遇寒加重，为寒邪盛，称为痛痹（D错）。痹证是由于风、寒、湿、热等外邪侵袭人体，痹阻经络，气血运行不畅，引起肢体关节筋骨、肌肉发生疼痛、重着、酸楚、麻木，或关节屈伸不利、僵硬、肿大、变形等症状的一类疾病（E错）。